我国目前空气质量预报的污染物项目不包括
A. SO₂
B. NO₂
C. CO
D. TSP
E. O₃

正确答案：E。O₃

解析：本题考查我国目前空气质量预报的污染物项目。我国目前空气质量预报的污染物项目包括SO₂（A对）、NO₂（B对）、CO（C对）、TSP（D对）等。颗粒物粒径小于100μm的称为TSP，即总悬浮物颗粒；粒径小于10μm的称为PM₁₀，即可吸入颗粒；粒径小于2.5μm的称为PM2.5。TSP和PM₁₀在粒径上存在着包含关系，即PM₁₀为TSP的一部分。O₃（E错，为本题正确答案）不是我国目前空气质量预报的污染物项目。